菌斑控制指标，如能达到多少即属基本被控制
A. 10％以下
B. 15％以下
C. 20％以下
D. 25％以下
E. 30％以下

正确答案：C。20％以下

解析：本题考查菌斑控制。菌斑记录卡能反映患者自我控制菌斑效果的信息。通常，在患者首次菌斑染色记录时，阳性百分率较高，但接受口腔卫生指导后，若能认真地按要求执行，在菌斑记录的百分率会明显下降，若达到20%以下（C对），则属基本被控制。